龋病的病程是
A. 急性进行性
B. 慢性间断性
C. 慢性进行性
D. 急性间断性
E. 以上都是

正确答案：C。慢性进行性

解析：本题考查龋病。龋病是牙体硬组织发生慢性进行性破坏的一种疾病（C对），致龋的多种因素包括细菌和牙菌斑，食物及牙所处的环境，病因学角度而言，龋病也可称为牙体硬组织的细菌感染性疾病，患龋病时，牙体硬组织的病理改变涉及牙釉质、牙本质和牙骨质 ，基本变化是微生物将蔗糖转化为酸，从而造成无机物脱矿和有机物分解。